“阳脉之海”指的是
A. 足太阳经脉
B. 阳维脉
C. 带脉
D. 督脉
E. 冲脉

正确答案：D。督脉

解析：督脉（C对）主一身之阳气，人体阳经均与督脉交汇，有调节阳经气血的作用，故称为“阳脉之海”；足太阳膀胱经（A错），本经从头走足，主要治疗头、目、项、腰、下肢部病证、神志病以及相关脏腑、组织器官病证；阳维脉（B错）起于诸阳会，联络诸阳经。主一身之表；带脉（C错）是所有经脉中唯一一条横行的经脉，环腰一周，有约束全身纵行经脉的作用，可概括为“总束诸脉”，健运腰腹和下肢；冲脉（E错）起于胞中，主要与足少阴肾经并行，不参与气血循环流注，本经为十二经气血通行之要冲，故称“十二经之海”。